患者进食海鲜后，次日出现剧烈水样腹泻，无腹痛及里急后重。为确诊，应做的检查是
A. 血常规
B. 粪便常规
C. 粪便常规及悬滴检查
D. 粪便常规及痢疾杆菌培养
E. 粪便隐血试验

正确答案：C。粪便常规及悬滴检查

解析：霍乱弧菌通常通过污染的水产品等引起传播。本例患者于进食海鲜后出现剧烈水样腹泻，无腹痛及里急后重，故诊断首先考虑是霍乱。为确诊，应做的检查是粪便常规及悬滴检查（C对B错）。霍乱粪便常规检查在显微镜下可见革兰染色阴性的弧菌，呈鱼群样排列。悬滴检查可见穿梭状运动的弧菌。血常规（A错）、粪便隐血试验（E错）对霍乱意义不大。痢疾杆菌培养（D错）主要用于诊断细菌性痢疾，对霍乱意义不大。